寻常型天疱疮早期出现病损的部位是
A. 口腔
B. 前胸
C. 头皮
D. 腹股沟
E. 食管黏膜

正确答案：A。口腔

解析：寻常型天疱疮：口腔是早期出现病损的部位。掌握“天疱疮”知识点。